效能强度最大的局麻药物是
A. 普鲁卡因
B. 布比卡因
C. 利多卡因
D. 阿替卡因
E. 丁卡因

正确答案：E。丁卡因

解析：本题考查局麻药。效能强度最大的局麻药物是丁卡因（E对）。丁卡因又名地卡因，与普鲁卡因相比，其作用强10～20倍，毒性也大10～20倍。以普鲁卡因效能强度1、毒性强度1为标准（A错）；布比卡因效能强度8，毒性强度4（B错）；利多卡因效能强度2，毒性强度2（C错）；阿替卡因效能强度1.9，毒性强度1～1.5（D错）；丁卡因10～20，毒性强度10～20。